生产、销售劣药，对人体健康造成危害，后果特别严重的
A. 处十年以上有期徒刑、无期徒刑或死刑，并处以罚金或没收财产
B. 处十年以上有期徒刑、无期徒刑，并处以罚金或没收财产
C. 处七年以下有期徒刑、并处以罚金
D. 处二年以上七年以下有期徒刑，并处以罚金
E. 处七年以上有期徒刑或者无期徒刑，并处以罚金或没收财产

正确答案：B。处十年以上有期徒刑、无期徒刑，并处以罚金或没收财产

解析：本题考查生产、销售、使用劣药的刑事责任。生产、销售劣药，对人体健康造成危害，后果特别严重的处十年以上有期徒刑、无期徒刑，并处以罚金或没收财产（B对）。根据《刑法》第一百四十二条规定，生产、销售劣药，对人体健康造成严重危害的，处三年以上十年以下有期徒刑，并处罚金；后果特别严重的，处十年以上有期徒刑或者无期徒刑，并处罚金或者没收财产。